硝苯地平适用于下列哪种疾病
A. 高血压
B. 心绞痛
C. 心律失常
D. 脑血管疾病
E. 以上选项均正确

正确答案：E。以上选项均正确

解析：硝苯地平临床应用于：①高血压；②心绞痛；③心律失常；④脑血管疾病；⑤外周血管痉挛性疾病。还用于预防动脉粥样硬化的发生。此外，钙通道阻滞药还可用于支气管哮喘、偏头痛等。掌握“钙通道阻滞药药理作用和不良反应”知识点。